紫苏的主治病证有
A. 风寒感冒
B. 脾胃气滞
C. 胸痹心痛
D. 气滞胎动
E. 食鱼中毒

正确答案：A、B、D、E。风寒感冒；脾胃气滞；气滞胎动；食鱼中毒

解析：本题考查的是紫苏的主治病证。紫苏的主治病证有风寒感冒（A对）、脾胃气滞（B对）、气滞胎动（D对）与食鱼中毒（E对）。紫苏：【主治病证】（1）风寒感冒，咳嗽胸闷。（2）脾胃气滞证。（3）气滞胎动证。（4）食鱼蟹中毒引起的腹痛吐泻。山楂：【主治病证】（1）食滞不化，肉积不消，泻痢腹痛。（2）瘀血痛经、闭经，产后瘀阻腹痛，胸痹心痛（C错）。（3）疝气偏坠胀痛。